下列除哪项外均可出现周围性呕吐
A. 洋地黄中毒
B. 急性胃炎
C. 胃穿孔
D. 胆囊炎
E. 咽部受激惹

正确答案：A。洋地黄中毒

解析：呕吐是通过胃的强烈收缩迫使胃或部分小肠内容物经食管、口腔而排出体外的现象，其按病因可分为周围性呕吐、中枢性呕吐、前庭障碍性呕吐以及急性中毒所导致的呕吐。急性胃炎（B对）、胃穿孔（C对）、胆囊炎（D对）、咽部受激惹（E对）所引起的呕吐均属于周围性呕吐。洋地黄中毒（A错，为本题正确答案）所引起的呕吐属于急性中毒所导致的中枢性呕吐。